患者，女，30岁。尿频、尿痛2天。检查：体温38℃，右肾区叩击痛，尿蛋白(±)，尿中红细胞2～4／HP，白细胞20～30／HP。应首先考虑的是
A. 急性膀胱炎
B. 急性肾炎
C. 急性肾盂肾炎
D. 尿道综合征
E. 右肾结石

正确答案：C。急性肾盂肾炎

解析：青年女性患者，尿频、尿痛（急性肾盂肾炎常见的膀胱刺激征）2天，检查：体温38℃（提示轻度发热），右肾区叩击痛，尿蛋白(±)，尿中红细胞2～4/HP（新鲜尿离心沉渣检查每高倍视野红细胞超过3个，称为镜下血尿），白细胞20～30/HP（新鲜尿离心沉渣检查每个高倍镜视野白细胞超过5个，称为白细胞尿，提示有泌尿系感染），应首先考虑的是急性肾盂肾炎（C对）。急性膀胱炎（A错）主要表现为尿频、尿急、尿痛等膀胱刺激征，一般无发热和肾区叩击痛。急性肾炎（P469）（B错）临床表现主要为血尿、蛋白尿、水肿、高血压等。尿道综合征（P500）（D错）常无真性细菌尿，一般不会出现白细胞尿。右肾结石（E错）多为肾区疼痛伴肋脊角叩击痛，少见发热和尿频、尿痛等症状。